牛黄醒消丸与连翘败毒丸功能相似，二者均能清热解毒、消肿止痛。二者的不同之处在于牛黄醒消丸还能
A. 活血祛瘀
B. 拔毒生肌
C. 化瘀祛腐
D. 化腐生肌
E. 软坚散结

正确答案：A。活血祛瘀

解析：本题考查的是连翘败毒丸与牛黄醒消丸的功能。牛黄醒消丸与连翘败毒丸均能清热解毒、消肿止痛。二者不同之处在于牛黄醒消丸还能活血祛瘀（A对）。连翘败毒丸：【功能】清热解毒，消肿止痛。牛黄醒消丸：【功能】清热解毒，活血祛瘀，消肿止痛。拔毒生肌散：【功能】拔毒生肌（B错）。紫草膏：【功能】化腐生肌（D错），解毒止痛。乳癖消胶囊：【功能】软坚散结（E错），活血消痈，清热解毒。功能为化瘀祛腐（C错）的中成药，2022年考试指南未明确说明。